下列哪一个属碳青霉烯类β-内酰胺类抗生素
A. 舒巴坦钠
B. 他唑巴坦
C. 亚胺培南
D. 氨曲南
E. 克拉维酸钾

正确答案：C。亚胺培南

解析：本题考查碳青霉烯类抗生素。亚胺培南（C对）为典型的碳青霉烯类药物。舒巴坦钠（A错）和他唑巴坦（B错）为青霉烷砜类抗菌药物。氨曲南（D错）属于单环β-内酰胺抗生素。克拉维酸（E错）属于氧青霉烷类。